下列有关片剂辅料应用的叙述，正确的是
A. 中药浸膏粉制粒常用乙醇作黏合剂
B. 若主药剂量小于1g则制片时需加稀释剂
C. 颗粒（或粉末）压片前必须加入润滑剂
D. 含中药浸膏量较多且黏性较大而制片困难者应加用吸收剂
E. 中药片剂均需加用崩解剂

正确答案：C。颗粒（或粉末）压片前必须加入润滑剂